下列哪项是强心苷类药物不具有的药理作用
A. 减慢心率
B. 增加衰竭心脏的耗氧量
C. 增加衰竭心脏的心输出量
D. 缩短心脏收缩期，相对延长舒张期
E. 抑制心肌细胞膜上的Na⁺-K⁺-ATP酶

正确答案：B。增加衰竭心脏的耗氧量

解析：衰竭心脏心肌收缩力降低，射血时间延长，心室内残余血量增加，心室容积增大，患者耗氧量增加，强心苷通过增强心肌收缩力，进而纠正上述变化降低心肌总耗氧量（B错，为本题正确答案）。强心苷是一类选择性作用于心脏，具有加强心肌收缩力作用的苷类化合物，治疗量的强心苷使心肌收缩力加强，心输出量增加，从而刺激主动脉弓和颈动脉窦压力感受器，反射性地使迷走神经兴奋性增加，交感神经兴奋性降低，心率减慢（A对）。心力衰竭时心肌收缩无力，心输出量减少，治疗量的强心苷使心肌收缩力加强，增加衰竭心输出量（C对）。强心苷直接作用于心脏，加快心肌收缩速度，缩短心脏收缩期，相对延长舒张期（D对），静脉回流充分，回心血量增多，保证心输出量提高。强心苷抑制心肌细胞膜Na⁺-K⁺-ATP酶（E对），使浦肯野细胞内失钾，负值减少，自律性提高，易引起室性早搏等心律失常。